适用于凝血因子缺乏的创面渗血
A. 指压止血
B. 包扎止血法
C. 填塞止血法
D. 结扎止血法
E. 药物止血法

正确答案：E。药物止血法

解析：药物止血法适用于创面渗血（凝血因子缺乏）、小静脉和小动脉出血。掌握“口腔颌面部创伤急救”知识点。